知母皂苷属于
A. 四环三萜皂苷
B. 五环三萜皂苷
C. 甾体皂苷
D. 强心苷
E. 氰苷

正确答案：C。甾体皂苷

解析：本题考查的是知母皂苷分类。知母皂苷属于甾体皂苷（C对）。知母中的化学成分主要为甾体皂苷和芒果苷，还含有木脂素、甾醇、鞣质、胆碱等成分。《中国药典》上将知母皂苷BⅡ和芒果苷定为知母药材的质量控制成分，要求知母皂苷BⅡ含量不得少于3.0%，芒果苷的含量不得少于0.7%。饮片指标低于原药材，如蓝知母要求知母皂苷BⅡ含量不得少于2.0%，芒果苷含量不得少于0.40%。知母根茎中含皂苷约6%，其类型分别为螺甾烷醇类（如知母皂苷AⅢ等）、异螺甾烷醇类（如知母皂苷Ⅰ）和呋甾烷醇类（如知母皂苷BⅤ等）。三萜的种类很多，但以皂苷形式存在的三萜类型并不多，较为常见的有羊毛甾烷型、达玛烷型、齐墩果烷型、乌苏烷型和羽扇豆烷型，其中前两种属于四环三萜，后三种则属于五环三萜。1.四环三萜（A错）：结构与甾醇很类似。主要有以下类型。（1）羊毛甾烷型，如猪苓酸A。（2）达玛烷型，如20（S）-原人参二醇。2.五环三萜（B错）：主要有以下类型。（1）齐墩果烷型，此类以齐墩果酸最为多见。（2）乌苏烷型，此类大多是乌苏酸的衍生物。（3）羽扇豆烷型，如羽扇豆种子中存在的羽扇豆醇，酸枣仁中分得的白桦醇和白桦酸等。强心苷（D错）由强心苷元与糖缩合而成。天然存在的强心苷元是C₁₇侧链为不饱和内酯环的甾体化合物。氰苷（E错）主要指一类α-羟腈的苷，属于氧苷的一种。如苦杏仁苷等。